冬春季多见于1岁以内的婴幼儿，以阵发性喘憋为主要症状，血白细胞总数正常，胸片可见小片状阴影，有不同程度肺气肿最可能是
A. 支原体肺炎
B. 金黄色葡萄球菌肺炎
C. 衣原体肺炎
D. 腺病毒肺炎
E. 呼吸道合胞病毒肺炎

正确答案：E。呼吸道合胞病毒肺炎

解析：冬春季多见于1岁以内的婴幼儿，以阵发性喘憋为主要症状，血白细胞总数正常，胸片可见小片状阴影，有不同程度肺气肿最可能是呼吸道合胞病毒肺炎（E对），支原体肺炎（A错）主要表现为咳嗽，初为干咳，后为顽固性剧咳，病初有全身不适、乏力、头痛。2-3天后出现发热，体温常达39℃左右，持续1-3周，可伴有咽痛和肌肉酸痛。金黄色葡萄球菌肺炎（B错）临床特点为起病急、病情严重、进展快，全身中毒症状明显，发热多呈弛张热型，外周血白细胞明显增高。衣原体肺炎（C错）临床特点为隐匿发病，大部分为轻症，无特异性临床表现，肺部偶闻及干、湿啰音或哮鸣音，胸部X线检查可见到肺炎病灶，多为单侧下叶浸润。腺病毒肺炎（D错）临床特点为起病急骤、高热持续时间长、中毒症状重、啰音出现较晚、X线改变较肺部体征出现早，易合并心肌炎和多器官功能障碍。